两名青年男子，食用大量鲨鱼肝后，相继出现疲乏、食欲下降、腹痛、腹泻、肝肿大、皮肤瘙痒、毛发脱落、骨关节疼痛，你认为哪种中毒可能性最大
A. 维生素A中毒
B. 维生素B₁₂中毒
C. 维生素E中毒
D. 维生素K中毒
E. 维生素PP中毒

正确答案：A。维生素A中毒